氨苄西林对下列哪一项无效
A. 伤寒沙门菌
B. 大肠埃希菌
C. 痢疾志贺菌
D. 铜绿假单胞菌
E. 百日咳鲍特菌

正确答案：D。铜绿假单胞菌

解析：氨苄西林的抗菌作用：对G-杆菌有较强的抗菌作用，如对伤寒沙门菌、副伤寒沙门菌、百日咳鲍特菌、大肠埃希菌、痢疾志贺菌等均有较强的抗菌作用，对铜绿假单胞菌无效，对粪链球菌作用优于青霉素G。掌握“青霉素及头孢菌素类药”知识点。